控制菌斑的方法中，不能有效去除菌斑的方法是
A. 刷牙
B. 漱口
C. 牙签
D. 牙线
E. 洁治

正确答案：B。漱口

解析：刷牙或使用牙线、牙签，洁治等机械方法是去除牙菌斑、清洁牙、保持口腔卫生的重要措施。一般漱口大多是利用水在口内流动的冲击力去除滞留的食物残屑，能暂时减少口腔微生物的数量，使口腔保持清新，但漱口的力量不足以去除牙菌斑。掌握“菌斑控制及提高宿主抵抗力”知识点。